医患关系的重要性体现在
A. 建立良好的医患关系，可以减少法律上的纠纷
B. 建立良好的医患关系，可以拓展良好的社会关系网络
C. 建立良好的医患关系，可提高医院的经济效益
D. 建立良好的医患关系，可促进双方进一步亲密的交往
E. 建立良好的医患关系，可促进诊疗工作的顺利开展

正确答案：E。建立良好的医患关系，可促进诊疗工作的顺利开展

解析：医患关系的重要性至少包括以下两方面：保障医疗工作的顺利开展、营造良好的心理气氛。掌握“医患沟通的理论、技术与其应用以及医患关系模式”知识点。